对腮腺的扪诊检查应选用
A. 一般以示、中、无名三指平触
B. 双手合诊法
C. 双指双合诊法
D. 双指提拉式扪诊
E. 单指扪诊

正确答案：A。一般以示、中、无名三指平触

解析：腮腺和下颌下腺的触诊应包括腺体和导管。腮腺触诊一般以示、中、无名三指平触为宜，忌用手指提拉触摸。掌握“口外一般检查及辅助检查”知识点。